促进Hb转变为HbO2的因素是
A. CO2分压增高
B. 氧分压增高
C. 血液H+增高
D. 温度增加
E. 血液pH下降

正确答案：B。氧分压增高

解析：人体中的血红蛋白（Hb）在氧分压较低时，结合氧形成氧合血红蛋白（HbO2）的能力较低，但随着氧分压的不断增高，在不超出Hb的结合氧的饱和范围内，其结合能力随着氧分压的增高而增高。掌握“蛋白质结构与功能关系”知识点。